病例对照研究的性质是
A. 回顾性研究
B. 前瞻性研究
C. 描述性研究
D. 理论性研究
E. 干预性研究

正确答案：A。回顾性研究